强心苷类药物地高辛引起的主要不良反应
A. 低钾血症
B. 高钾血症
C. 高镁血症
D. 心律失常
E. 踝足肿胀

正确答案：D。心律失常

解析：本题考查地高辛。强心苷类药物地高辛引起的主要不良反应为心律失常（D对）。地高辛常见的不良反应有胃肠道不良反应、神经系统反应及视觉障碍、心律失常，但其本身不能引起低钾血症（A错）、高钾血症（B错）和高镁血症（C错）；踝足肿胀（E错）是钙通道阻滞剂的典型不良反应。